痢疾的病位在
A. 胃
B. 肠
C. 脾
D. 肾
E. 肝

正确答案：B。肠

解析：痢疾的发生多由外感湿热、疫毒之邪，内伤饮食，损及脾胃与肠，邪气客于大肠，与气血搏结，肠道脂膜血络受伤，传导失司，而致下痢。